受体与配体结合形成的复合物可以被另一种配体置换，体现的受体性质是
A. 可逆性
B. 选择性
C. 特异性
D. 饱和性
E. 灵敏性

正确答案：A。可逆性

解析：本题考查受体的特性。受体与配体结合形成的复合物可以被另一种配体置换，体现的受体性质是可逆性（A对）。配体与受体的结合是可逆的，配体与受体复合物可以解离，解离后可得到原来的配体而非代谢物。特异性（C错）：受体对其配体有高度识别能力，对配体的化学结构与立体结构具有很高的专一性，特定的受体只能与其特定的配体结合，产生特定的生物学效应。同一化合物的不同光学异构体与受体的亲和力相差很大。饱和性（D错）：受体数量有限，能与其结合的配体量也有限，因此受体具有饱和性，在药物的作用上反映为最大效应。受体具有饱和性，因此作用于同一受体的配体之间存在竞争现象。灵敏性（E错）：受体能识别周围环境中微量的配体，只需很低浓度的配体就能与受体结合而产生显著的效应。